某医院内科病房，责任护士误将甲床患者的青霉素注射给乙床患者。发现错误后，该护士心里十分矛盾和紧张，对乙床患者进行严密观察，没有出现青霉素过敏反应。对此以下说法符合伦理的是
A. 患者没出现过敏反应，为避免护士与患者发生矛盾，不应告诉患者
B. 打错针后护士已经进行了严密的观察，避免了医疗事故产生
C. 打错针后应及时将情况上报主管的护士长，进行观察并采取进一步治疗
D. 患者未出现过敏反应，可以不告诉护士长以免受处分
E. 住院患者太多，护理任务紧张，出错在所难免

正确答案：C。打错针后应及时将情况上报主管的护士长，进行观察并采取进一步治疗

解析：不伤害原则是指在医务人员的整个医疗行为中，无论动机，还是效果，均应避免对病人造成伤害。医务人员应尽可能提供最佳的诊治、护理手段，防范无意但却可知的伤害，把不可避免但可控的伤害控制在最低限度。患者具有知情同意的权利，无论患者后续有无出现过敏反应，该护士均应遵循不伤害原则，将情况告诉患者，争取患者的谅解（A错），并主动上报主管的护士长，进行观察并采取进一步治疗（C对D错），否则极有可能发生医疗事故（B错）。虽然住院患者很多会造成护理任务的紧张，医务人员应谨慎而行可把事故发生的概率降至最低甚至避免出错（E错）。